第一次提出社会医学概念的学者是
A. 法国医师盖林
B. 古希腊哲学家希波克拉底
C. 德国医学家诺尔曼
D. 病理学家魏尔啸
E. 英国医师玛利逊

正确答案：A。法国医师盖林

解析：本题考查第一次提出社会医学概念的学者。第一次提出社会医学概念的学者是法国医师盖林（A对BCDE错）。